男，2岁。1个月来食欲减退、消瘦伴乏力，近2周低热、盗汗、干咳。2个月前曾患麻疹。查体：消瘦，未见瘢痕，颈部可触及数个肿大淋巴结，质硬，无明显压痛，心脏检查未见异常，右肺可闻及少许干湿啰音，肝肋下3cm，脾不大。主要治疗药物是
A. 阿昔洛韦
B. 异烟肼+利福平
C. 异烟肼+泼尼松
D. 头孢曲松
E. 阿奇霉素

正确答案：B。异烟肼+利福平

解析：患儿食欲减退，消瘦乏力，低热盗汗，为结核病的全身中毒症状。2个月曾患麻疹（有急性传染病史，可导致免疫力暂时降低），查体颈部有数个肿大质硬无压痛的淋巴结，肝肋下3cm，综上考虑诊断为肺结核。由于小儿以原发型肺结核多见，，故本例应诊断为原发性肺结核。一般无明显自觉症状的原发型肺结核使用标准疗法异烟肼+利福平和（或）乙胺丁醇（B对）。阿昔洛韦（A错）、头孢曲松（C错）和阿奇霉素（E错）不是临床上常用的抗结核药物，且结核治疗原则为联合用药，单独用药不予考虑。